上述反佐药含义的表述，正确的是
A. 针对主病或主证起主要治疗作用
B. 针对重要的兼病或兼证起主要治疗作用
C. 针对次要兼证起直接治疗作用
D. 消减或制约君臣药的毒性和峻烈之性
E. 防止病重邪甚时药病格拒

正确答案：E。防止病重邪甚时药病格拒

解析：防止病重邪甚时药病格拒，是反佐药的作用（E对）。针对主病或主证起主要治疗作用，是君药的作用（A错）。针对重要的兼病或兼证起主要治疗作用，是臣药的作用（B错）。针对次要兼证起直接治疗作用，是佐助药的作用（C错）。消减或制约君臣药的毒性和峻烈之性，是佐助药的作用（D错）。